寒邪中阻，宿食不化，腹痛拒按，舌苔白厚，脉象可见
A. 滑数
B. 弦紧
C. 结代
D. 细涩
E. 迟缓

正确答案：B。弦紧

解析：滑数脉多见于痰热[火]、湿热或食积内热（A错）。弦紧脉多见于寒证、痛证，弦脉主肝胆病、疼痛、痰饮等，紧脉主实寒证、疼痛、宿食，寒邪、疼痛可致肝失疏泄，气机郁滞，血气敛束不伸，脉管失去柔和之性，弹性降低，紧张度增高，出现弦脉，寒为阴邪，主收引，可致脉管收缩紧束而拘急，正气未虚，正邪相争，气血向外冲击有力，脉来绷急而搏指，形成紧脉，故题中脉象为弦紧脉（B对）。结脉多见于阴盛气结、寒痰血瘀，亦可见于气血虚衰。代脉多见于脏气衰微、疼痛、惊恐、跌仆损伤等（C错）。细脉主气虚俱虚，湿证，涩脉主精伤、血少、气滞、血瘀，痰食内停（D错）。迟脉主寒证，亦可见于邪热结聚，缓脉主湿病，脾胃虚弱，亦可见于常人（E错）。